在面颊部出现落叶型天疱疮典型的鳞屑性、结痂性皮损，口腔损害少见。属于
A. 颗粒型天疱疮
B. 增殖型天疱疮
C. 落叶型天疱疮
D. 寻常型天疱疮
E. 红斑型天疱疮

正确答案：E。红斑型天疱疮

解析：红斑型天疱疮现认为红斑型天疱疮是落叶型天疱疮的一种局限型。红斑型天疱疮在面颊部出现对称的红斑及鳞屑，像全身性红斑狼疮的损害。口腔损害无或少见。掌握“天疱疮”知识点。